神经-骨骼肌接头处的兴奋传递物质是
A. 5-羟色胺
B. 乙酰胆碱
C. 去甲肾上腺素
D. 肾上腺素
E. 多巴胺

正确答案：B。乙酰胆碱